女，45岁，左手示指被鱼刺扎破5天，患指红，肿，痛伴发热3天，查体:T:38.5℃，左手示指甲旁红肿，有脓点，触痛明显，有波动感。目前最恰当处理方法是
A. 外敷鱼石脂软膏
B. 拔甲
C. 切开引流
D. 红外线诊疗
E. 应用抗生素

正确答案：C。切开引流

解析：该患者女，45岁，左手示指被鱼刺扎破5天，患指红，肿，痛伴发热3天，查体:T:38.5℃，左手示指甲旁红肿，有脓点，触痛明显，有波动感，结合患者出现的表现，诊断为甲沟炎，处理方法应行切开引流（C对），未化脓时，可外敷鱼石脂软膏、红外理疗、口服敏感抗菌药物（ADE错）。甲根脓肿出现，才需要拔甲（B错）。